26岁初孕妇，现妊娠40周，近半月头痛、眼花，今晨出现剧烈头痛并呕吐2次来院就诊。测血压180/110mmHg。最有参考价值的病史是
A. 既往血压正常
B. 有高血压家族史
C. 有青光眼病史
D. 既往无头痛史
E. 有患病毒性肝炎史

正确答案：A。既往血压正常

解析：掌握“娠期高血压疾病”知识点。